分布于下肢内侧后缘的是
A. 足太阳膀胱经
B. 足太阴脾经
C. 足少阴肾经
D. 足厥阴肝经
E. 足阳明胃经

正确答案：C。足少阴肾经

解析：阴经行内侧，阳经行外侧，足太阳膀胱经分布于下肢外侧后缘（A错）；足太阴脾经分布于下肢内侧前缘（B错）；足少阴肾经分布于下肢内侧后缘（C对）；足厥阴肝经分布于下肢内侧中线（D错）；足阳明胃经分布于下肢外侧前缘（E错）。